在相同条件下如果固定桥桥体的长度增加一倍，则其挠曲变量变为
A. 增加至原来的4倍
B. 增加至原来的2倍
C. 增加至原来的6倍
D. 增加至原来的8倍
E. 增加至原来的9倍

正确答案：D。增加至原来的8倍

解析：本题考查影响桥体弯曲变形的有关因素。在相同条件下如果固定桥桥体的长度增加一倍，则其挠曲变量变为增加至原来的8倍（D对）。桥体的厚度与长度，尤其是桥体的金属（牙合）面和金属桥架的厚度与长度，与桥体的抗弯强度密切相关。在相同条件下，桥体的弯曲变形量与桥体厚度的立方成反比；与桥体长度的立方成正比。也可以说，桥体的厚度越大，桥体的抗弯性越大；桥体的长度越长，桥体的抗弯性越差。